女，45岁，四肢无力，站立不稳，进行性加重半年，无外伤史。查体：双下肢肌张力高腱反射亢进。Hoffmann征（+），Babinski征（+）。其诊断为
A. 脊髓型颈椎病
B. 神经根型颈椎病
C. 椎动脉型颈椎病
D. 交感神经型颈椎病
E. 混合型颈椎病

正确答案：A。脊髓型颈椎病

解析：患者四肢无力、站立不稳、进行性加重半年（脊髓型颈椎病典型表现），无外伤史，双下肢肌张力高、腱反射亢进、Hoffmann征（+）、Babinski征（+）（脊髓型颈椎病的体征），结合患者临床表现和体查，该患者应诊断为脊髓型颈椎病（A对）。神经根型颈椎病（P726）（B错）多由于颈椎间盘向侧后方突出，压迫神经根所致，引起颈肩痛，并向该神经根所支配的上肢区域放射，同时可有上肢无力、手指动作不灵活的表现，体查可有牵拉试验及压头试验阳性。椎动脉型颈椎病（P727）（C错）主要表现为突发性眩晕而猝倒、偏头痛、听力减退或耳聋、视力障碍等。交感神经型颈椎病（P727）（D错）主要表现为交感神经受刺激的症状，可为兴奋性也可为抑制性。混合型颈椎病（E错）多有两种或多种类型症状同时出现。